全目赤肿的临床意义是
A. 脾胃湿热
B. 肝经风热
C. 心脾积热
D. 肺热壅盛
E. 肾经虚火

正确答案：B。肝经风热

解析：望目是望诊的重要内容，正常人眼睑内及两眦红润，白睛色白，黑睛褐色或棕色，角膜无色透明。若双眼或单眼白睛红赤，伴见肿痛，多属实热证。全目赤肿，多为肝经风热上攻（B对）。